白血病的牙龈病损的原因
A. 末梢血中的幼稚血细胞在牙龈组织内大量浸润积聚
B. 牙龈结缔组织本身的增生
C. 牙龈结缔组织部分的红细胞大量浸润积聚
D. 牙菌斑大量堆积
E. 口内自洁作用差

正确答案：A。末梢血中的幼稚血细胞在牙龈组织内大量浸润积聚

解析：白血病患者末梢血中的幼稚血细胞在牙龈组织内大量浸润积聚，致使牙龈肿大，这是白血病的牙龈病损的原因，而并非牙龈结缔组织本身的增生。由于牙龈肿胀、出血，口内自洁作用差，使菌斑大量堆积，加重牙龈的炎症。掌握“白血病龈病损”知识点。